第Ⅰ躯体运动区所在的皮质区是
A. 4、6
B. 3、1、2
C. 41、42
D. 17
E. 6、8

正确答案：A。4、6

解析：第Ⅰ躯体运动区所在的皮质区是4区和6区（A对）。皮质3、1、2区（B错）为第Ⅰ躯体感觉区。皮质41、42区（C错）为第1听区。皮质17区（D错）为第1视区。皮质6、8区（E错）为书写区。